下列不属于心包穿刺的指征是
A. 心脏压塞
B. 为证实心包积液的存在
C. 为明确心包积液的性质
D. 心包积脓
E. 心包内药物治疗

正确答案：B。为证实心包积液的存在

解析：心包穿刺术的指征：1.心脏压塞（A对）；2.明确心包积液的性质（C对），协助病因诊断；3.心包内药物治疗（E对），如心包积脓（D对）时，经过穿刺排脓、冲洗和注药尚可达到一定的治疗作用。由于心包穿刺具有一定的风险性，临床一般选择超声心动图来证实心包积液的存在（B错，为本题正确答案）。